一种新疗法只能延缓死亡，但不能治愈疾病，以下哪种情况将会发生
A. 该病患病率减少
B. 该病患病率增加
C. 该病发病率增加
D. 该病发病率减少
E. 该病的发病率和患病率均减少

正确答案：B。该病患病率增加